下列晚发型矽肺发生的条件中哪项是错误的
A. 接尘浓度高
B. 粉尘中的游离SiO₂含量高
C. 接尘年限短
D. 脱尘时X线胸片未见明显异常
E. 身体比较虚弱

正确答案：E。身体比较虚弱

解析：本题考查晚发型矽肺的诱因。有些接尘者，在短时间内（C对）接触高浓度（B对）、高游离SiO₂含量（A对）的粉尘，但在脱离粉尘作业时X线胸片未发现明显异常（D对），或发现异常但尚不能诊断为矽肺，在脱离接尘作业若干年后被诊断为矽肺，称为“晚发型矽肺”。晚发型矽肺和速发性矽肺的区别在于接尘者的个人体质有关。身体素质的强弱（E错，为本题正确答案）不是晚发型矽肺的诱发条件。